洋地黄毒苷为
A. 五碳醛糖
B. 糖醛酸
C. 六碳糖
D. 2，6-二去氧糖
E. 二糖

正确答案：D。2，6-二去氧糖

解析：本题考查的是糖的分类。洋地黄毒苷为2，6-二去氧糖（D对）。2，6-二去氧糖有洋地黄毒糖等。五碳醛糖（A错）有木糖、阿拉伯糖、核糖等。糖醛酸（B错）有葡萄糖醛酸、半乳糖醛酸等。六碳糖（C错）有葡萄糖、甘露糖、半乳糖等。二糖（E错）有龙胆二糖、麦芽糖、芸香糖等。